下列关于蛋白质理化性质的描述，正确的是
A. 变性后溶解度提高
B. 溶液pH值为等电点时形成兼性离子
C. 复性时产生分子杂交
D. 具有260nm特征吸收峰
E. 溶于高浓度乙醇

正确答案：B。溶液pH值为等电点时形成兼性离子

解析：蛋白质变性后其理化性质及生物学性质发生改变，其溶解度降低（A错），高浓度乙醇能导致蛋白质变性，其溶解度降低，所以不会溶解于高浓度乙醇（E错）。当蛋白质溶液处于某一pH时，蛋白质解离成正、负离子的趋势相等，即成为兼性离子，净电荷为零，此时溶液的pH称为蛋白质的等电点（B对）。核酸具有260nm特征吸收峰（D错），蛋白质的特征吸收峰值是280nm。